《中国药典》中，以大黄素和大黄素甲醚为质量控制成分的中药是
A. 雷公藤
B. 肉桂
C. 细辛
D. 何首乌
E. 秦皮

正确答案：D。何首乌

解析：本题考查的是含蒽醌类化合物的常用中药。《中国药典》中，以大黄素和大黄素甲醚为质量控制成分的中药是何首乌（D对）。何首乌的主要成分为蒽醌类成分，以大黄素、大黄酚、大黄素甲醚、大黄酸、芦荟大黄素等为主，《中国药典》以二苯乙烯苷和结合蒽醌为指标成分进行含量测定，要求何首乌含二苯乙烯苷不得少于1.0%，制何首乌含二苯乙烯苷不得少于0.70%；对何首乌和制何首乌要求结合蒽醌均不得少于0.10%（以大黄素和大黄素甲醚计）。雷公藤（A错）中主要化学成分为雷公藤甲素、雷公藤乙素和雷公藤红素等。其中，雷公藤甲素为二萜类化合物，不是生物碱。肉桂（B错）中主要化学成分及其结构：肉桂皮含挥发油1%～2%。《中国药典》以桂皮醛为指标成分进行含量测定，并以挥发油作为质量控制指标，要求其含量不得少于1.2%（ml/g）。油中的主要成分为肉桂醛含量达75%～85%，并含少量乙酸桂皮酯、肉桂酸、乙酸苯丙酯等。辽细辛（C错）的主要化学成分为挥发油、木脂素类和黄酮类等。挥发油约占其含量的3%。《中国药典》以细辛脂素为指标成分进行含量测定，含量不得少于0.050%。同时规定挥发油不得少于2.0%（ml/g）。细辛含有痕量的马兜铃酸Ⅰ，有肝肾毒性。《中国药典》对马兜铃酸Ⅰ进行限量检查，要求其含量不得过0.001%。秦皮（E错）中主要含七叶内酯（秦皮乙素）和七叶苷（秦皮甲素），《中国药典》采用高效液相色谱法并规定本品按干燥品计，含秦皮甲素、秦皮乙素的总量不得少于1.0%。